烤瓷熔附金属全冠舌侧边缘肩台宽度是
A. 1mm
B. 2mm
C. 3mm
D. 1.5mm
E. 0.5mm

正确答案：E。0.5mm

解析：本题考查烤瓷熔附金属全冠的颈缘预备。烤瓷熔附金属全冠舌侧边缘肩台宽度是0.5mm（E对）。颈缘预备要求：（1）舌侧或邻面颈部如以金属为冠边缘者，颈缘可预备成羽状、凹槽形或直角斜面形。（2）唇颊侧或全冠边缘为烤瓷者，应将牙体颈缘预备成直角或135°凹面，以保证颈缘瓷的强度和美观。采用龈下边缘者，肩台位于龈缘下0.5mm。（3）唇颊侧肩台宽度一般为1.0mm。若预备不足，要么颈部瓷层太薄，出现金属色或透明度降低，冠边缘的强度下降；要么为了保证强度而增加冠边缘突度，致使颈部外形与牙颈部不一致，冠颈部形成肿胀外观。若预备过多，可能会引起牙髓损害，因为颈部髓腔壁厚度一般为1.7-3.0mm。舌侧金属边缘处肩台宽度0.5mm。